生活技能具体表现的10种能力中不包括
A. 自我认识能力
B. 同理能力
C. 有效交流能力
D. 组织能力
E. 人际关系能力

正确答案：D。组织能力